男，48岁。一年来每于剧烈活动时或饱餐后发作性剑突下疼痛，向咽部放射，持续数分钟可自行缓解。2周来发作频繁且有夜间睡眠中发作。2小时来疼痛剧烈，不能缓解，向胸部及后背部放射。伴憋闷，大汗。此时最有帮助诊断的辅助检查是
A. 超声心动图
B. 胸部X线
C. 心电图
D. 心肌酶谱
E. CT

正确答案：C。心电图

解析：中年男性患者，一年来每于剧烈活动或饱餐后发作性剑突下疼痛（心绞痛常见诱因），向咽部放射，数分钟可自行缓解（提示心绞痛病史）。近期发作频繁且有夜间睡眠中发作（提示病情加重），2小时来疼痛剧烈，不能缓解，向胸部及后背放射，伴憋闷，大汗（心肌梗死典型症状），综合该患者的病史、体查，该患者首先考虑的诊断是急性心肌梗死（AMI），此时最有帮助诊断的辅助检查是心电图（C对）。心电图应在患者到达急诊室10分钟内完成，典型表现为ST段抬高呈弓背向上型。超声心动图（A错）有助于了解心室壁的运动和左心室功能。胸部X线（B错）对急性心肌梗死并无特异性的诊断意义，一般用于了解其他心肺疾病的情况。心肌酶谱（D错）主要包括天冬氨酸氨基转移酶（AST）、乳酸脱氢酶（LDH）、肌酸激酶（CK）和肌酸激酶同工酶（CK-MB），但前三者由于特异性及敏感性较差，目前不再用于诊断AMI（P239）。目前常用的血清心肌坏死标志物有：①肌红蛋白：起病2小时内出现，但特异性差；②肌酸激酶同工酶（CK-MB）：起病4小时内升高，3～4天后恢复正常，对早期AMI、再发心肌梗死的诊断有重要价值；③肌钙蛋白I（cTnI）或T（cTnT）：诊断NSTEMI的金指标，多数患者在症状出现4小时后升高，甚至部分患者出现假阴性，从而延误诊断和治疗。该患者发病2小时心肌酶谱并无异常增高。CT（E错）一般不用于诊断心肌梗死。